下列关于溶血性黄疸的叙述，正确的是.
A. 直接迅速反应阳性
B. 尿中结合胆红素阴性
C. 血中非结合胆红素不增加
D. 尿胆原阴性
E. 大便呈灰白色

正确答案：B。尿中结合胆红素阴性

解析：溶血性黄疸，血中非结合胆红素增加（C错），结合胆红素不增加，故直接迅速反应阴性（A错）；尿胆原阳性（D错），但尿中结合胆红素阴性（B对）；粪胆原增加，粪色加深（E错）。